药品批发企业的药品常温库的温度不得高于
A. 10℃
B. 15℃
C. 20℃
D. 25℃
E. 30℃

正确答案：E。30℃